合欢皮的功效是
A. 定惊安神
B. 宁心安神
C. 解郁安神
D. 补气安神
E. 养心安神

正确答案：C。解郁安神

解析：本题考查合欢皮的功效。合欢皮的功效是解郁安神（C对）。合欢皮【功效】解郁安神，活血消肿。琥珀【功效】安神定惊（A错），活血散瘀，利尿通淋。景天三七【功效】化瘀止血，宁心安神（B错），解毒。刺五加【功效】补气（D错）健脾，益肾强腰，养心安神（E错），活血通络。